既能息风止痉，又能祛风湿，止痹痛的药物是
A. 羚羊角
B. 石决明
C. 决明子
D. 天麻
E. 珍珠

正确答案：D。天麻

解析：该题考查的是天麻的功效，属记忆内容。天麻的功效 息风止痉，平抑肝阳，祛风通络（D对）。